免疫球蛋白不具有的作用是
A. 中和外毒素
B. 激活补体经典途径
C. 调理作用
D. 介导ADCC作用
E. 参与Ⅳ型超敏反应

正确答案：E。参与Ⅳ型超敏反应